巩膜静脉窦位于
A. 巩膜与角膜交界处
B. 角膜与虹膜交界处
C. 角膜与球结膜结合处
D. 虹膜与睫状体交界处
E. 面神经管凸

正确答案：A。巩膜与角膜交界处

解析：巩膜静脉窦位于巩膜与角膜交界处（A对），而非角膜与虹膜交界处（B错）或角膜与球结膜结合处（C错）或虹膜与睫状体交界处（D错）或面神经管凸（E错）。